介水传染病一般多见于
A. 中毒性疾病
B. 肠道传染病
C. 呼吸道传染病
D. 皮肤病
E. 免疫性疾病

正确答案：B。肠道传染病

解析：本题考查介水传染病一般多见于的疾病。介水传染病指通过饮用或接触受病原体污染的水而传播的疾病。一般多见于肠道传染病（B对ACDE错）。